髋关节囊内韧带
A. 髂股韧带
B. 股骨头韧带
C. 坐股韧带
D. 髋臼横韧带
E. 耻股韧带

正确答案：B。股骨头韧带

解析：股骨头韧带位于关节内，连接股骨头凹和髋臼横韧带之间（B对）。